可抑制Th0细胞向Th2细胞转化的是
A. IL-5
B. IL-4
C. IFN-γ
D. TNF-α
E. IL-8

正确答案：C。IFN-γ